血液中降钙素主要由哪种细胞产生
A. 胰岛A细胞
B. 胰岛B细胞
C. 甲状腺C细胞
D. 甲状旁腺细胞
E. 小肠上部S细胞

正确答案：C。甲状腺C细胞